各类营养与糖尿病的关系描述中错误的是
A. 糖尿病患者过高摄入碳水化合物时，极易出现高血糖
B. 摄入高脂膳食时，可使血糖上升
C. 摄入高蛋白质膳食时，可使血糖明显上升
D. 膳食补充三价铬和适当补硒对糖尿病有预防和辅助治疗作用
E. 糖尿病患者应多食膳食纤维含量丰富的粗粮

正确答案：C。摄入高蛋白质膳食时，可使血糖明显上升